患儿4岁,右下乳Ⅳ缺失,乳Ⅴ因根尖周病做根管治疗后,采用间隙保持器是
A. 远中导板式间隙保持器
B. 舌弓式间隙保持器
C. 带环丝圈式间隙保持器
D. Nance腭弓间隙保持器
E. 可摘式间隙保持器

正确答案：C。带环丝圈式间隙保持器

解析：本题考查间隙保持器的种类和适应证。患儿4岁,右下乳Ⅳ缺失,乳Ⅴ因根尖周病做根管治疗后,采用间隙保持器是带环丝圈式间隙保持器（C对）。1.带环/全冠丝圈式间隙保持器的适应证：（1）单侧第一乳磨牙早失。（2）第一恒磨牙萌出后，单侧第二乳磨牙早失。（3）双侧各有单颗乳磨牙早失，用其他间隙保持器装置困难的病例。2.远中导板式间隙保持器（A错）的适应证：适于第二乳磨牙早失、第一恒磨牙尚未萌出或萌出中。用第一乳磨牙作基牙，戴入预成的或自制的合金全冠，冠的远中端焊接弯曲导板，插入牙槽窝内，远中导板贴合于未萌出的第一恒磨牙的近中面。3.舌弓式间隙保持器（B错）多用于下颌乳牙列及混合牙列侧方牙群早失，需要保持尖牙-前磨牙的萌出间隙的病例。通常在下颌切牙萌出后使用，以免影响其萌出及正常排列。其适应证有：在两侧各有第二乳磨牙或第一恒磨牙为基牙时，适应证如下：（1）乳尖牙早失。（2）多颗乳磨牙早失，特别是近期有个别继承恒牙即将萌出仍需保持牙弓长度者。（3）患儿不能合作配戴可摘式功能保持器。4.Nance弓（腭托）式间隙保持器（D错）与舌弓式间隙保持器的用途一致，用于上颌缺牙间隙的保持。5.可摘式间隙保持器（E错）的适应证：乳磨牙缺失两颗以上者，或两侧乳磨牙缺失，或伴有前牙缺失。